对病毒性感染进行血清血诊断时，双份血清抗体效价至少增高几倍时，才有诊断意义
A. 2倍
B. 4倍
C. 8倍
D. 16倍
E. 32倍

正确答案：B。4倍

解析：血清学诊断的标本，应在患者急性期和恢复期各取一份血液，以便对比双份血清中抗体效价，通常恢复期血清的抗体效价比急性期增高4倍以上才有诊断意义。掌握“病毒感染检查方法及防治原则”知识点。